一谷物的赖氨酸评分为0.42，苏氨酸0.70，蛋氨酸1.04，缬氨酸0.96，色氨酸1.10。该谷物的氨基酸分是
A. 0.42
B. 0.7
C. 1.04
D. 0.96
E. 1.1

正确答案：A。0.42